下列开放性创伤中可以进行清创缝合
A. 面部锐器伤6小时的伤口
B. 已有脓性分泌物的伤口
C. 有明显局部红、肿、热、痛的伤口
D. 刚被手术缝针刺伤的伤口
E. 四肢损伤超过18小时的伤口

正确答案：A。面部锐器伤6小时的伤口

解析：开放性伤口常有污染，应行清创术目的是将污染伤口变成清洁伤口，为组织愈合创造良好条件。清创时间越早越好，伤后6-8小时内清创一般都可达到一期愈合（A对）。已有脓性分泌物的伤口（B错）或有明显局部红、肿、热、痛的伤口（C错）均提示有感染应行清创术但是不应该给予缝合。刚被手术缝针刺伤的伤口（D错）清创后不需要缝合。四肢损伤超过18小时（E错）的伤口（超过8-12小时）行清创术后暂时不缝合，伤口内留置盐水纱条引流，24-48小时后伤口仍无明显感染者，可将缝合创面。